不进入血液的病毒是
A. 狂犬病病毒
B. 脊髓灰质炎病毒
C. 麻疹病毒
D. 登革病毒
E. 人类免疫缺陷病毒

正确答案：A。狂犬病病毒

解析：人被动物咬伤或抓伤后，病毒可通过伤口进入体内，先在肌肉组织内复制增殖并感染肌神经，不经血行，而是沿神经轴索上行扩散至脊髓、大脑等致细胞损伤，在大脑海马回的椎体细胞质内可见圆形或椭圆形的嗜酸性包涵体即内基氏（Negri）小体，此为诊断动物狂犬病的指征。掌握“狂犬病、人乳头瘤病毒”知识点。